18岁女孩，2小时前左下腹部剧烈疼痛，恶心呕吐2次，体温37.5℃。肛查子宫右侧触及活动良好触痛明显手拳大肿物。本例最可能的诊断是
A. 盆腔炎性包块
B. 输卵管结核
C. 卵巢子宫内膜异位囊肿破裂
D. 子宫浆膜下肌瘤扭转
E. 卵巢肿瘤蒂扭转

正确答案：E。卵巢肿瘤蒂扭转

解析：该患者2小时前左下腹部剧烈疼痛，伴恶心、呕吐，体温37.5℃（蒂扭转的典型症状是体位改变后突然发生一侧下腹剧痛，常伴恶心、呕吐甚至休克）。肛查：子宫右侧触及活动良好触痛明显手拳大肿物，最可能的诊断是卵巢肿瘤蒂扭转（E对）。盆腔炎性包块（P261）（A错）常见的症状是慢性腹痛，压痛明显和局部压迫刺激症状，活动度差，无突发的腹部剧烈疼痛的表现。输卵管结核（P265）（B错）多表现为不孕、月经失调，妇检可在子宫两侧触及条索状或结节状输卵管，活动度差。卵巢子宫内膜异位囊肿破裂（P271）（C错）时囊内容物流入腔引起突发性剧烈腹痛，伴恶心、呕吐和肛门坠胀，但此类囊肿粘连严重，活动度差。子宫浆膜下肌瘤扭转（P312）（D错）可有急性腹痛，也可蒂扭转断裂，形成游离性肌瘤，但肌瘤常见于30～50岁妇女，20岁以下少见。